1，25-（OH）₂D₃的生理功能是
A. 促进钙磷经肠道吸收作用增强
B. 抑制肾曲小管对磷的吸收，增进对钙的重吸收
C. 抑制骨盐溶解，使血清钙含量降低
D. 使7-脱氢维生素D₃变为维生素D₃
E. 促进维生素D₃转化为25-羟维生素D₃

正确答案：A。促进钙磷经肠道吸收作用增强

解析：本题考查1，25-（OH）₂D₃的生理功能。1，25-（OH）₂D₃的生理功能是促进钙磷经肠道吸收作用增强（A对BCDE错）。1，25-（OH）₂D₃是维持钙磷代谢平衡的主要激素之一，它通过对肠、肾、骨等靶器官的作用发挥其抗佝偻病的生理功能：①促进小肠黏膜细胞合成钙结合蛋白，以增加肠道对钙的吸收；②增加肾小管对钙磷的重吸收，减少尿磷的排除，提高血磷浓度，有利于骨的钙化作用；③促进成骨细胞的增殖和碱性磷酸酶的合成，促进骨钙素的合成，促进间叶细胞向成熟破骨细胞分化，从而发挥其骨质重吸收效应；④促进旧骨质脱钙，使旧骨质中骨盐溶解，钙、磷运到血液中，增加细胞外液中钙、磷浓度，促进成骨细胞的功能。